丘脑2017U3ZXY2017U3-内囊出血内侧型最典型的临床表现是
A. 血行脑脊液
B. 神经系统"三偏征"
C. 意识障碍
D. 四肢抽搐
E. 脑膜刺激征

正确答案：B。神经系统"三偏征"

解析：神经系统“三偏征”指的身体出现了偏瘫、偏身的感觉障碍、偏盲，是内囊处病变的典型症状。偏瘫，主要指的是大脑病变对侧的肢体出现了瘫痪；偏身的感觉障碍，指的是大脑病灶对侧的肢体感觉减退，有时针刺时会没有痛觉或者是痛觉、触觉等感觉较轻；而偏盲指的是病灶对侧同向出现偏盲状况（B对）；血行脑脊液首先要考虑蛛网膜下腔出血，其次还应考虑穿刺损伤局部的血管而引起的出血，这种情况下血性脑脊液的量比较少，可以适当的引流脑脊液，随着脑脊液引流的量的增多，血性脑脊液会逐渐的消失（A错）；意识障碍、四肢抽搐、脑膜刺激征均是丘脑-内囊出血的临床症状，但不是其典型临床表现（CDE错）。